患者，女，30岁。已婚3年不孕，月经2～3个月一行，头晕耳鸣，腰膝腿软，畏寒肢冷，性欲淡漠，舌淡苔白，脉沉细而迟。治疗应首选
A. 大补元煎
B. 固阴煎
C. 补肾固冲丸
D. 毓麟珠
E. 温胞饮

正确答案：E。温胞饮

解析：患者已婚三年不孕，月经2～3个月一行，是为不孕症，并伴有头晕耳鸣，腰疫腿软，畏寒肢冷，性欲淡漠等肾阳虚之征，故治疗要温肾暖宫，调补冲任方用温胞饮或右归丸（E对）。大补阴煎功效滋阴降火，治伴有潮热盗汗，咳嗽咯血，阴虚火旺之证的阴虚火旺证（A错）。固阴煎功效补益肾气，固冲调经，治疗伴有腰膝酸软，头晕耳鸣，面色晦黯或有黯斑等肾气不足之征的月经先期（B错）。补肾固冲汤功效补气健脾，益肾安胎，治脾肾两虚之证（C错）。毓麟珠治疗肾气虚证（E错）。